关于牙周袋临床表现与组织病理关系哪项是错误的
A. 牙龈呈暗红色，原因是结缔组织中龈纤维和血管四周胶原破坏
B. 牙龈呈暗红色，原因是局部血循环阻滞
C. 牙龈表面光亮，点彩消失原因是牙龈表面上皮萎缩，组织水肿
D. 探诊后出血原因是牙周袋内上皮变性、变薄，并有溃疡
E. 有时袋内溢脓，原因是袋内有化脓性炎症

正确答案：A。牙龈呈暗红色，原因是结缔组织中龈纤维和血管四周胶原破坏

解析：本题考查牙周袋临床表现与组织病理关系。牙周袋临床表现与组织病理关系：牙龈呈暗红色，原因是局部血循环阻滞（B对），结缔组织中龈纤维和血管四周胶原破坏的临床表现是牙龈质地松软（A错，为本题的正确答案）。牙龈表面光亮，点彩消失原因是牙龈表面上皮萎缩，组织水肿（C对）。探诊后出血原因是牙周袋内上皮变性、变薄，并有溃疡（D对）有时袋内溢脓，原因是袋内有化脓性炎症（E对）。有时龈色粉红，且致密原因是袋的外侧壁有明显的纤维性修复，但袋内壁仍存在炎性改变。